药品储存过程中，受外界哪些因素的影响，会发生质量变化
A. 温度
B. 湿度
C. 日光照射
D. 空气中的二氧化碳
E. 声波

正确答案：A、B、C、D。温度；湿度；日光照射；空气中的二氧化碳

解析：本题考查药品储存要求。药品储存过程中，受温度（A对）、湿度（B对）、日光照射（C对）和空气中的二氧化碳（D对）的影响，会发生质量变化。医疗机构储存药品，应当制订和执行有关药品保管、养护的制度，并采取必要的冷藏、防冻、防潮、避光、通风、防火、防虫、防鼠等措施，保证药品质量，所以，药品储存过程中要注意温度、湿度、日光照射和二氧化碳的影响。